下列各项违背了不伤害原则的是
A. 有证据证明，生物学死亡即将来临而病人痛苦时，允许病人死亡
B. 积极强迫病人进行各种实验室检查
C. 不对病人做与诊断无关的检查
D. 糖尿病病人足部有严重溃疡，有发生败血症的危险时，应予以截肢
E. 妊娠危及孕妇生命时，可行人工流产

正确答案：B。积极强迫病人进行各种实验室检查

解析：在医疗活动中，绝对的不伤害是不可能的。很多检查、治疗措施，可能给患者带来生理或理上的伤害。相反，如果诊治手段对患者是无益的、不必要的或者是禁忌的，而又有意无意地勉强实施，从而使患者受到伤害，就违背了不伤害原则。对于符合适应证可能带来的伤害要注意尽量避免或将伤害减少到最低限度，不能强迫病人进行各种实验室检查（B错，为本题正确答案）。对医务人员提出如下要求：1.树立不伤害的意识，在医疗活动中首先想到不伤害患者，杜绝有意和责任伤害，不可避免但可控的伤害控制在最低限度；2.善于权衡伤害和受益，对有危险或有伤害的医疗措施进行评价，只有相对千受益，危险或伤害能够接受，才符合不伤害原则（ACDE对）。